男，32岁。腹泻3个月，大便每日7～10次，稀便，无脓血及黏液。有吸毒史2年。查体：T37.5度，消瘦，神志清楚，肛门周围可见疱疹。实验室检查：粪便镜检偶见白细胞。为明确诊断，最重要的检查是
A. 抗单纯疱疹病毒IgM
B. 抗EBV IgM
C. 结核抗体
D. 抗CMV IgM
E. 抗HIV

正确答案：E。抗HIV

解析：患者为青年男性，腹泻3个月，大便每日7-10次，稀便，无脓血及黏液，有吸毒史2年（吸毒是HIV感染的高危人群），消瘦，神志清楚，肛门周围可见疱疹，粪便镜检偶见白细胞，考虑诊断为艾滋病（吸毒人员是HIV的感染的高危人群，且患者连续腹泻超过一个月以上，低热，身体消瘦，消化系统出现感染，符合HIV的临床表现）。而HIV-1/HIV-2抗体检测是HIV感染诊断的金标准，因此为确诊最重要的检查为抗HIV检查（E对）。